动机产生的两个条件是
A. 需要和目的
B. 需求和目标
C. 诱因与目的
D. 意志与目的
E. 需要与诱因

正确答案：E。需要与诱因

解析：动机是引起和维持个体的活动，并使活动朝着一定目标的内部心理动力。引起动机的两个条件有内在条件和外在条件。需要是个体的内在条件，是推动人们活动的直接原因。诱因是产生动机的外在条件（E对）。